先天性甲状腺功能减低症新生儿筛查是检测血
A. T₃
B. T₄
C. TSH
D. TRH
E. TG

正确答案：C。TSH

解析：新生儿血滴纸片检测TSH浓度的方法，采集标本方便，假阳性和假阴性率较低，是患儿早期确诊、避免神经精神发育严重缺陷、减轻家庭和社会负担的重要防治措施。如初筛TSH浓度大于15-20mU/L 再检测血清T4、TSH以确诊（C对）。